类白血病样反应
A. 骨髓细胞内可见Auer小体
B. 中性粒细胞碱性磷酸酶积分增高
C. Ph染色体阳性
D. 糖原染色阳性
E. 非特异性酯酶（+），阳性可被氟化钠抑制

正确答案：B。中性粒细胞碱性磷酸酶积分增高

解析：类白血病反应是某种因素刺激机体的造血组织而引起的某种细胞增多或左移反应，似白血病现象，有中性粒细胞碱性磷酸酶积分增高（B对）。Auer小体出现在急性早幼粒细胞白血病和骨髓增生异常综合征中（A错）。ph染色体特异性见于慢性粒细胞性白血病（C错）。糖原染色阳性主要见于急性淋巴细胞白血病（D错）。非特异性酯酶（+）可见于急性单核细胞白血病和急性粒细胞白血病；非特异性酯酶（+），阳性可被氟化钠抑制只见于急性单核细胞白血病（E错）。